患者大便艰涩，腹痛拘急，胀满拒按，胁下偏痛，手足不温，呃逆呕吐，舌苔白腻，脉弦紧。治疗应首选
A. 麻子仁丸
B. 六磨汤
C. 温脾汤合半硫丸
D. 济川煎
E. 更衣丸

正确答案：C。温脾汤合半硫丸

解析：麻子仁丸为热秘的选方，功能润肠泄热，行气通便（A错）。六磨汤为气秘的选方，功能调理肝脾，通便导滞（B错）。患者以大便艰涩，腹痛拘急，胀满拒按为主症，故诊断为便秘，大便艰涩，腹痛拘急，胀满拒按为阴寒之邪凝滞肠胃，寒性凝滞收引所致，阴寒内盛阻遏阳气不能达于四末，故手足不温，寒邪凝滞于胃，胃纳失常，故呃逆呕吐，舌苔白腻，脉弦紧为寒邪内盛之象，故辨为冷秘，治宜温里散寒，通便止痛，方选温脾汤合半硫丸（C对）。济川煎为阳虚秘的选方，功能温补肾阳，润肠通便（D错）。更衣丸为热秘兼郁怒伤肝，易怒目赤的选方，功能清肝通便（E错）。